下列属于自身免疫反应直接引起组织损伤的机制是
A. T细胞杀伤
B. 自身抗原的改变
C. 隐蔽抗原的释放
D. 表位扩展
E. 分子模拟

正确答案：A。T细胞杀伤

解析：自身免疫是指机体的免疫系统对自身的组织细胞成分发生免疫应答，使自身反应性淋巴细胞活化，产生自身抗体和（或）自身反应性T细胞（A对），损伤表达相应自身抗原的靶器官组织， 导致自身免疫病的发生。自身抗原的改变（B错）、隐蔽抗原的释放（C错）、表位扩展（D错）、分子模拟（E错）都属于自身免疫性疾病发生的相关因素。